2002年12月广西某地山区一辆满载数吨剧毒化学品砒霜的卡车翻落在深山峡谷中，大部分毒物抛撒到谷底的河流里，而下游15km的居民则以这条河的水作为饮用水水源。生活饮用水水质卫生标准中砷的最高容许浓度（mg/L）是
A. 10
B. 5
C. 0.01
D. 0.05
E. 2

正确答案：C。0.01

解析：本题考查生活饮用水水质卫生标准中砷的最高容许浓度（mg/L）。生活饮用水水质卫生标准规定生活饮用水砷含量不得超过0.01mg/L（C对ABDE错）。